肝的疏泄作用主要影响机体的
A. 气机运行
B. 脾胃运化
C. 情志变化
D. 胆汁的生成
E. 月经的调节

正确答案：A。气机运行

解析：本题考查的是肝的生理功能。肝的疏泄作用主要影响机体的气机运行（A对）。肝的生理功能。肝的生理功能主要有两方面：一是主疏泄，二是藏血。1.肝主疏泄：肝主疏泄，是指肝气具有疏通、畅达全身气机，进而调畅精血津液的运行输布、脾胃之气的升降（B错）、胆汁的分泌排泄（D错）以及情志活动（C错）等作用。肝的疏泄功能反映了肝为刚脏、主升、主动的生理特点，中心环节是调畅全身气机。肝主疏泄，调畅全身气机功能，具体体现在五个方面：（1）调畅情志。（2）协调脾胃升降。（3）促进胆汁生成与排泄。（4）促进血液运行和津液代谢。（5）调畅排精行经（E错）。2.肝主藏血：肝藏血，是指肝具有贮藏血液、调节血量和防止出血的功能。（1）贮藏血液。（2）调节血量。（3）防止出血。